患者，男，40岁，右下后牙遇冷不适，无自发疼，1年前患者曾一次补牙，检查：右下7（牙合）面树脂充填物边缘破裂。可钩住探针，叩（-），冷侧敏感，刺激后疼痛立刻消失。最可能的诊断是
A. 中龋
B. 深龋
C. 继发龋
D. 急性牙髓炎
E. 慢性牙髓炎

正确答案：C。继发龋

解析：继发龋：龋病治疗后，由于充填物边缘或窝洞周围牙体组织破裂，形成菌斑滞留区，或修复材料与牙体组织不密合，留有小的缝隙或存在微渗漏，或原有的病变组织未除净就进行充填，这些都可能形成致病条件，再发生龋病，称继发龋。掌握“龋病的诊断及鉴别诊断”知识点。